地区性的生长发育评价标准，修订的周期应该是
A. 3～5年
B. 5～10年
C. 10～15年
D. 15～20年
E. 21～25年

正确答案：B。5～10年